管理舌后1/3一般感觉神经来自
A. 面神经
B. 舌下神经
C. 舌咽神经
D. 下颌神经
E. 迷走神经

正确答案：C。舌咽神经

解析：管理舌后1/3一般感觉神经来自舌咽神经（C对）。面神经（A错）管理舌前2/3味觉（特殊内脏感觉）、耳部小块皮肤的浅感觉和面肌的本体感觉（一般躯体感觉）。舌下神经（B错）为运动性神经，支配舌内肌和大部分舌外肌。下颌神经（D错）管理颞部、耳前、口裂以下的皮肤，口腔底和舌前2/3黏膜及下颌牙和牙龈的一般感觉（一般躯体感觉）。迷走神经（E错）管理胸腹腔脏器等的感觉（一般内脏感觉）。